阴损及阳的病机是指
A. 阴虚，阳气失制而偏盛
B. 阴虚，阳气失制而偏衰
C. 阴虚，累及阳气化生，阳亦亏
D. 阴盛于内，格阳于外
E. 以上均非

正确答案：C。阴虚，累及阳气化生，阳亦亏

解析：阴损及阳指由于阴气亏损，累计阳气生化不足，或阳气无所依附而耗散，从而在阴虚的基础上又出现阳虚，形成以阴虚为主的阴阳两虚的病机变化（C对）；阴偏衰的病机特点是阴液不足，阴不制阳，阳气相对偏盛（AB错）；阴盛格阳指阳气极虚导致阴寒之气偏盛，壅闭于里，逼迫阳气浮越于外而出现内真寒外假热的病机变化（D错）。